齿燥如枯骨，属
A. 热盛伤津
B. 阳明热盛
C. 肾阴枯涸
D. 胃阴不足
E. 肾气虚乏

正确答案：C。肾阴枯涸

解析：肾阴枯竭，精不上荣则见牙齿燥如枯骨，可见于温热病的晚期，属病重（C对）。胃肾热甚，热盛灼伤津液（A错），气津已竭，则牙齿焦干且无牙垢。阳明热甚（B错），津液大伤，牙齿光燥如石。若胃阴不足（D错），则牙齿干燥。肾虚（E错）或胃阴不足，虚火上炎，龈肉失养，则会导致牙龈萎缩，牙根暴露，牙齿松动，常有渗血和脓液，称为牙宣。